温室效应形成的原因是大面积森林的砍伐和燃料燃烧产生的
A. 大量CO₂
B. 大量NO₂
C. 大量SO₂
D. 大量CO
E. 以上都不是

正确答案：A。大量CO₂

解析：本题考查温室效应形成的原因。大气层中某些气体如CO₂等能吸收地表发射的热辐射，使大气增温，称为温室效应。温室效应形成的原因是大面积森林的砍伐和燃料燃烧产生的大量CO₂（A对BCDE错）。